蒲公英用量过大，可导致
A. 急性中毒
B. 缓泻
C. 便秘
D. 先兆流产
E. 血压降低

正确答案：B。缓泻

解析：本题考查的是蒲公英的使用注意。蒲公英用量过大，可导致缓泻（B对）。蒲公英：【使用注意】本品用量过大可致缓泻，故脾虚便溏者慎服。苍耳子：【使用注意】本品辛温有毒，过量服用易致中毒（A错），引起呕吐、腹痛、腹泻等，故用量不宜过大，血虚头痛者不宜服。服用不当导致便秘（C错）、先兆流产（D错）或血压降低（E错）的中药，2022年考试指南未明确说明。